慢性牙周炎的主要病因是
A. 家族遗传
B. 龈下菌斑和龈下牙石
C. 病毒感染
D. 龈下牙石
E. 全身疾病

正确答案：B。龈下菌斑和龈下牙石

解析：牙周病的始动因子是牙菌斑，牙菌斑矿化形成牙石，所以龈下菌斑和龈下牙石是慢性牙周炎的主要病因。掌握“慢性牙周炎的病因，表现诊断及预后”知识点。